镍铬合金全冠抛光所用抛光剂是
A. 氧化铁
B. 氧化铬
C. 硼砂
D. 浮石
E. 石膏

正确答案：B。氧化铬

解析：本题考查常见的抛光材料。金属全冠制作完成后要进行抛光，否则易形成菌斑。抛光要根据合金种类选择不同的抛光剂。镍铬合金全冠抛光所用抛光剂是氧化铬（B对），其结晶体极硬，极稳定。使用氧化铁（A错）抛光镍铬合金，会使其变色影响美观，故不能使用，其适用于贵金属抛光。硼砂（C错）主要用来抛光烤瓷冠或全瓷冠，浮石（D错）主要用来抛光全口义齿的基托磨光面，如果用来抛光金属全冠，硬度不够，效果不佳。石膏（E错）不是抛光剂。